颈动脉鞘内不含有
A. 颈总动脉
B. 颈内动脉
C. 颈内静脉
D. 迷走神经
E. 膈神经

正确答案：E。膈神经

解析：颈鞘，又称颈动脉鞘，颈血管鞘，呈管状。该鞘上方附着于颅底颈静脉孔和颈动脉管外口周缘的颅骨外膜；下方止于锁骨胸骨端和胸锁关节的深面。由鞘内伸出间隔，分隔鞘内诸内容。在鞘内，颈内静脉居于外侧，颈内动脉或颈总动脉位于内侧，迷走神经行走于上述动静脉之间的后方。而颈深筋膜深层把颈鞘与深面的膈神经、颈交感神经干及颈丛神经隔开。掌握“颈部分区、颈筋膜层次及下颌下三角解剖特点”知识点。